对高血压合并心力衰竭，一旦出现舒张功能不全，可在常规治疗基础上加用
A. 噻嗪类利尿剂
B. 醛固酮受体拮抗剂
C. 血管紧张素转换酶抑制剂
D. α受体阻断剂
E. β受体阻断剂

正确答案：E。β受体阻断剂

解析：本题考查特殊人群高血压的治疗。对高血压合并心力衰竭，一旦出现舒张功能不全，可在常规治疗基础上加用β受体阻断剂（E对）。高血压合并心力衰竭，症状较轻者除控制体重，限制盐量，积极降低血压外，用ACEI和β受体阻断剂。ACEI有助于逆转左室肥厚或阻止肥厚加重。一旦出现舒张功能不全，在常规治疗的基础上还应考虑加用β受体阻断剂。噻嗪类利尿剂（A错）和醛固酮受体拮抗剂（B错）适用于老年高血压、单纯收缩期高血压等。血管紧张素转换酶抑制剂（C错）适用于伴慢性心力衰竭、心肌梗死后伴心功能不全、糖尿病肾病等。α受体阻断剂（D错）适用高血压伴前列腺增生患者。